妇女更年期的生理变化，主要与下列哪个器官的衰老密切相关
A. 子宫
B. 卵巢
C. 乳腺
D. 下丘脑
E. 垂体

正确答案：B。卵巢

解析：本题考查更年期的相关内容。妇女更年期的生理变化，主要与卵巢（B对ACDE错）的衰老密切相关。卵巢的衰老主要表现在卵泡减少和卵巢形态变化及卵巢功能衰退。伴随着卵巢的衰老，更年期妇女会出现生殖、泌尿、心血管等多个相关系统与器官的变化。